下列药物中，长于清利头目的是
A. 葛根
B. 柴胡
C. 升麻
D. 蔓荆子
E. 淡豆豉

正确答案：D。蔓荆子

解析：该题考查蔓荆子的功效，属记忆内容。蔓荆子功效 疏散风热，清利头目（D对）。